与抗组胺药联用，可减少西药用量的是
A. 木防己汤
B. 济生肾气丸
C. 小青龙汤
D. 六味地黄丸
E. 桂枝茯苓丸

正确答案：C。小青龙汤